软胶囊的崩解时限为
A. 5min
B. 15min
C. 30min
D. 45min
E. 60min

正确答案：E。60min

解析：本题考查的是胶囊剂的崩解时限。软胶囊的崩解时限为60min（E对）。崩解时限：硬胶囊的崩解时限为30分钟（C错）、软胶囊的崩解时限为1小时。以明胶为基质的软胶囊可改在人工胃液中进行检查。肠溶胶囊先在盐酸溶液（9→1000）中检查2小时，每粒的囊壳均不得有裂缝或崩解现象，改在人工肠液中检查，1小时内应全部崩解。结肠肠溶胶囊先在盐酸溶液（9→1000）中检查2小时，每粒的囊壳均不得有裂缝或崩解现象，然后在磷酸盐缓冲溶液（pH6.8）中检查3小时，每粒的囊壳均不得有裂缝或崩解现象，改在磷酸盐缓冲溶液（pH7.8）中检查，1小时内应全部崩解。凡规定检查溶出度或释放度的胶囊剂，一般不再进行崩解时限的检查。崩解时限为5min（A错）的剂型为舌下片。舌下片各片均应在5分钟内全部崩解并溶化。崩解时限为15min（B错）或45min（D错）的剂型，2022年考试指南未明确说明。